骨折的专有体征是
A. 疼痛
B. 瘀斑
C. 功能障碍
D. 肿胀
E. 反常活动

正确答案：E。反常活动

解析：骨折的专有体征包括畸形、反常活动（E对）及骨擦音或骨擦感。疼痛（A错）、瘀斑（B错）、肿胀（D错）、功能障碍（C错）均为骨折的一般表现。